婴儿在4～6个月不可增加哪项辅食
A. 米糊
B. 蛋黄
C. 鱼泥
D. 菜泥
E. 碎菜

正确答案：E。碎菜

解析：添加过渡期食物（辅食）的时间和步骤（4个阶段）。根据小儿生长发育所需及消化吸收功能的成熟情况，按月龄顺序增加各类过渡期食物（辅食）。为方便起见，一般分四个阶段添加四类辅食。1～3个月：汁状食物，如水果汁、青菜汤、鱼肝油和钙剂。4～6个月：泥状食物，如米汤、米糊、稀粥、蛋黄、鱼泥、菜泥、果泥。7～9个月：末状食物，如粥、烂面、碎菜、蛋、鱼、肝泥、肉末、豆腐、饼干、馒头片、面包片、熟土豆、芋头等。10～12个月：碎状食物，如粥、软饭、烂面条、豆制品、碎菜、碎肉、带馅食品等。掌握“婴儿喂养方法”知识点。